在骨骼肌兴奋-收缩偶联中起关键作用的离子是
A. Na⁺
B. K⁺
C. Ca²⁺
D. Mg²⁺
E. Cl⁻

正确答案：C。Ca²⁺